生产性毒物在生产环境中存在的形态为
A. 气体、蒸气、气溶胶
B. 气体、液体、烟、固体
C. 蒸气、液体、固体、烟
D. 固体、液体、气体或气溶胶
E. 固体、液体、尘、雾

正确答案：D。固体、液体、气体或气溶胶